下列哪项概括了眩晕发生的病机
A. 痰、热、风、湿
B. 风、火、痰、瘀
C. 火、气、血、虚
D. 风、痰、气、血
E. 风、火、血、虚

正确答案：B。风、火、痰、瘀

解析：眩晕的发生，自古多有论述，概括起来不外风、火、痰、瘀。《素问·至真要大论》说：“诸风掉眩，皆属于肝。”肝风之动，有实有虚之分，肝阳化火，生风为实；肝肾阴虚，虚火上炎生风为虚。《丹溪心法·头眩》有“无痰不作眩”之说。《景岳全书·眩运》有“无虚不作眩”之论。《素问玄机原病式·五运主病》指出：“风火皆属阳，多为兼化，阳主乎动，两动相搏，则为旋转”（B对ACDE错）。